分解后产能最多的是
A. 葡萄糖
B. 硬脂酸
C. 丙氨酸
D. 三磷酸腺苷
E. 磷酸肌醇

正确答案：B。硬脂酸

解析：分解后产能最多的是硬脂酸（B对）。一分子硬脂酸彻底氧化需进行8次β-氧化，生成8分子FADH₂、8分子NADH及9分子乙酰辅酶A，每分子FADH₂产生1.5分子ATP，每分子NADH产生2.5分子ATP，每分子乙酰辅酶A经柠檬酸彻底氧化产生10分子ATP。一分子硬脂酸彻底氧化共产生（8×1.5）＋（8×2.5）＋（9×10）=122，脂肪酸活化消耗2分子ATP，所以1分子硬脂酸彻底氧化净生成120分子ATP。葡萄糖（A错）经过有氧氧化彻底分解，形成30或32分子ATP。丙氨酸转氨基后产生丙酮酸、NH₃、NADH和H⁺，丙酮酸脱羧成乙酰辅酶A产生2.5分子ATP，乙酰辅酶A通过柠檬酸循环产生10分子ATP，NH₃转运至肝脏，解毒成尿素消耗2.5分子ATP，NADH（NADPH）和H⁺，在线粒体中生成，产生2.5分子ATP，所以1分子丙氨酸彻底氧化产生12.5分子ATP（C错）。三磷酸腺苷（D错）及磷酸肌醇（E错）仅含一分子高能磷酸键，彻底氧化分解产能远小于硬脂酸。